根尖手术中哪种翻瓣术的缺点是手术通路不佳、易留下疤痕
A. 扇形瓣
B. 矩形瓣
C. 不规则形瓣
D. 半圆形瓣
E. 半月形瓣

正确答案：E。半月形瓣

解析：半月形瓣：由单一的弧形切口构成，这种瓣的缺点是手术通路不佳、易留下疤痕，临床上已较少使用。掌握“根尖手术”知识点。